下述丙酮酸脱氢酶复合体组成中辅酶，不包括哪种
A. TPP
B. FAD
C. NAD
D. HS-CoA
E. NADP

正确答案：E。NADP